伴有糖尿病周围神经痛的抑郁症患者，宜选用
A. 洛伐他汀
B. 氟西汀
C. 度洛西汀
D. 普伐他汀
E. 头孢西汀

正确答案：C。度洛西汀

解析：本题考查抑郁用药。对糖尿病周围神经痛抑郁患者可选用度洛西汀（C对），其为5-羟色胺及去甲肾上腺素在摄取抑制剂，是唯一可缓解糖尿病周围神经病所引起疼痛的药物。